根据桩核制作方式的不同，桩可分为
A. 铸造桩和预成桩
B. 金属桩和非金属桩
C. 铸造桩和非铸造桩
D. 预成桩与非预成桩
E. 铸造一体式桩和铸造分体桩

正确答案：A。铸造桩和预成桩

解析：桩核的类型根据桩核使用材料不同可分为金属桩核及非金属桩核。金属桩核又有贵金属桩核和非贵金属桩核之分。非金属桩核有玻璃纤维桩及瓷桩等。根据桩核制作方法不同，可分为预成桩加树脂核和铸造金属桩。掌握“桩核冠”知识点。